下列选项中不属于拔牙适应证的是
A. 滞留的乳牙影响恒牙正常萌出者
B. 因颌骨骨折或牙槽骨所累及的牙
C. 引起虹膜睫状体炎的病灶牙
D. 引起视网膜炎的病灶牙
E. 成人牙列中的乳牙，下方无恒牙，乳牙无松动且有功能者

正确答案：E。成人牙列中的乳牙，下方无恒牙，乳牙无松动且有功能者

解析：本题考查牙拔除的适应证与禁忌证。滞留的乳牙影响恒牙正常萌出者，应予拔除。但在成人牙列中的乳牙（E错，为本题正确答案），下方无恒牙（先天缺失）或恒牙阻生，乳牙无松动且有功能时，则不必拔除。